薄壁组织中散有分泌细胞，其内含橙黄色或橙红色油滴状物的药材是
A. 徐长卿
B. 白术
C. 龙胆
D. 天麻
E. 地黄

正确答案：E。地黄

解析：本题考查的是地黄的显微鉴别。薄壁组织中散有分泌细胞，其内含橙黄色或橙红色油滴状物的药材是地黄（E对）。地黄【显微鉴别】粉末生地黄、熟地黄：薄壁组织灰棕色至黑棕色，细胞多皱缩，内含棕色核状物。分泌细胞形状与一般薄壁细胞相似，内含橙黄色或橙红色油滴状物。具缘纹孔导管和网纹导管，直径约至92㎛。徐长卿（A错）【显微鉴别】茎横切面：表皮外被角质层。皮层最外1列外皮层细胞壁切向增厚。中柱鞘纤维断续成环。维管束双韧型。髓部有大空腔。白术（B错）【显微鉴别】粉末白术、麸炒白术：草酸钙针晶细小，长10～32㎛，不规则地充塞于薄壁细胞中。纤维长梭形，大多成束，壁甚厚，木化，孔沟明显。石细胞淡黄色，类圆形、多角形、长方形或少数纺锤形。薄壁细胞含菊糖，表面显放射状纹理。龙胆（C错）【显微鉴别】粉末：淡黄棕色。①外皮层细胞表面观类纺锤形，每一细胞由横隔壁分隔成2～20个扁方形子细胞，有的子细胞又被纵隔壁分隔成2个小细胞。②内皮层细胞表面观类长方形，甚大，平周壁显纤细的横向纹理，每个细胞被纵隔壁分隔成2～18个栅状子细胞，子细胞又常被横隔壁分隔成2～5个小细胞。③薄壁细胞含草酸钙小针晶，有的呈细梭状或颗粒状。④石细胞稀少（根茎），类圆形或类长方形。⑤导管多为网纹及梯纹，直径约至45㎛。天麻（D错）【显微鉴别】粉末：黄白色至黄棕色。①厚壁细胞椭圆形或类多角形，直径70～180㎛，壁厚3～8㎛，木化，纹孔明显。②草酸钙针晶成束或散在，长25～75㎛。③薄壁细胞近无色，细胞壁薄，纹孔较明显。④用醋酸甘油装片含糊化多糖类物的薄壁细胞无色，有的细胞可见长卵形、长椭圆形或类圆形颗粒状物质，遇碘液显棕色或淡棕紫色。⑤导管螺纹、网纹及环纹，直径8～30㎛。